在临床试验中，采用盲法的主要目的是
A. 使试验组与对照组更具可比性
B. 增加受试对象的依从性
C. 减少选择性偏倚
D. 减少主观因素引起的信息偏倚
E. 使研究更合乎道德

正确答案：D。减少主观因素引起的信息偏倚

解析：本题考查盲法的作用。实验流行病学研究中采用盲法可以减少主观因素引起的信息偏倚（D对ABCE错）。